患者，男，63岁，2型糖尿病病史20年，现服用二甲双胍0.5g，一日3次；阿卡波糖0.1g，一日3次；罗格列酮4mg，一日1次。既往高血压病史5年，冠心病病史5年，心功能I级，轻度肾功能不全，长期服用贝那普利、阿司匹林。患者拟次日行冠脉血管造影检查，应暂停使用的药物是
A. 阿卡波糖
B. 罗格列酮
C. 二甲双胍
D. 阿司匹林
E. 贝那普利

正确答案：C。二甲双胍

解析：本题考查二甲双胍片的用药监护。二甲双胍（C对）是2型糖尿病患者的一线治疗药，既可以降低空腹血糖，也可改善人体对胰岛素的敏感性，减轻患者体重。服药期间不要饮酒，乙醇可抑制肝糖异生，增加二甲双胍的降糖作用。接受外科手术和造影剂增强的影像学检查前需暂停口服。二甲双胍要避免与含碘造影剂、甲氧氯普胺、罗非昔布合用。